“夫医者，非仁爱之士不可托也；非聪明理达不可任也；非廉洁淳良不可信也。”此语出自下列哪位学者
A. 晋代杨泉
B. 宋代林普
C. 唐代孙思邈
D. 明代陈实功
E. 清代王清任

正确答案：A。晋代杨泉